不穿经眶上裂
A. 动眼神经
B. 视神经
C. 展神经
D. 滑车神经
E. 眼神经

正确答案：B。视神经

解析：动眼神经（A对）穿眶上裂入眶，分成上、下两支。视神经（B错，为本题正确选项）向后内行经视神经管入颅中窝，移行于间脑的视交叉。展神经（C对）经眶上裂入眶，支配外直肌。滑车神经（D对）经眶上裂入眶，越过上直肌和上睑提肌向前内侧走行，支配上斜肌。眼神经（E对）经眶上裂入眶，分布于眶内、眼球、泪器、结膜、硬脑膜、部分鼻和鼻旁窦黏膜、额顶部及上脸和鼻背部的皮肤。